醋鳖甲每100kg用醋量为
A. 12.5kg
B. 15kg
C. 17.5kg
D. 20kg
E. 25kg

正确答案：D。20kg